与HIV有关的口腔病损不包括
A. 红斑狼疮
B. 复发性溃疡
C. 线形牙龈红斑
D. 白色念珠菌感染
E. 坏死性溃疡性牙周炎

正确答案：A。红斑狼疮

解析：与HIV有关的口腔病损有：线形牙龈红斑、坏死性溃疡性牙龈炎、坏死性溃疡性牙周炎、毛状白斑、白色念珠菌感染、复发性溃疡等，晚期可发生Kaposi肉瘤。掌握“反应全身疾病的牙周炎”知识点。